下述制剂中属速效制剂的是
A. 异丙基肾上腺素气雾剂
B. 硝苯地平控释微丸
C. 肾上腺素注射剂
D. 硝酸甘油舌下片
E. 磺胺嘧啶混悬剂

正确答案：A、C、D。异丙基肾上腺素气雾剂；肾上腺素注射剂；硝酸甘油舌下片

解析：本题考查速效制剂。异丙基肾上腺素气雾剂（A对）、肾上腺素注射剂（C对）、硝酸甘油舌下片（D对）属于速效制剂。气雾剂吸入给药，到达肺部被迅速吸收，直接进入血液循环，为速释制剂；注射剂通过皮下注射进入血液循环；舌下片给药经舌下黏膜吸收，无首关效应；硝苯地平控释微丸（B错）为口服控释制剂；磺胺嘧啶混悬剂（E错）为口服液体制剂。